蒲黄的药用部位是
A. 花序
B. 花蕾
C. 花粉
D. 柱头
E. 开放的花

正确答案：C。花粉

解析：本题考查的是药材的药用部位。蒲黄的药用部位是花粉（C对）。药用部位为完整的花、花序或花的某一部分，这类中药称花类中药。完整的花有的是已开放的（E错），如洋金花、红花；有的是尚未开放的花蕾（B错），如丁香、金银花。药用花序（A错）亦有的是采收未开放的，如款冬花；有的要采收已开放的，如菊花、旋覆花。而夏枯草实际上采收的是带花的果穗。药用仅为花的某一部分，如西红花系柱头（D错），莲须系雄蕊，玉米须系花柱，松花粉、蒲黄等则为花粉粒等。